环境质量评价类型可以按评价时间分为回顾性评价、环境质量现状评价和
A. 大气质量评价
B. 环境影响评价
C. 水质评价
D. 土壤质量评价
E. 总环境质量评价

正确答案：B。环境影响评价

解析：本题考查环境质量评价按评价时间的分类。环境质量评价是从环境卫生学角度按照一定的评价标准和方法对一定区域范围内的环境质量进行客观的定性和定量调查分析、描述、评价和预测。环境质量评价按评价时间可分为回顾性评价、环境质量现状评价和环境影响评价（B对ACDE错）。回顾性评价是对评价区域内过去某阶段环境质最变化的评价，并预测其发展趋势；环境质量现状评价是对现时环境质量的评价，为当前的环境决策提供依据；环境影响评价是对拟议中的建设和工程项目等活动可能对环境产生的影响进行评价，体现了对源头污染的早期预防。